男，25岁，突感上腹部剧痛。检查：血压130/80mmHg，脉搏110次/分，板样腹，肠鸣音消失。血红蛋白120g/L，血白细胞数8.0×10⁹/L。若腹穿抽出较多液体，应尽早采取的治疗措施是
A. 胃肠减压输液
B. 镇痛镇静治疗
C. 全量应用抗生素
D. 输液纠正水电和酸碱失衡
E. 手术探查

正确答案：E。手术探查

解析：青年男性患者，突发上腹部剧痛，板样腹，肠鸣音消失（提示腹腔空腔脏器穿孔），血压、血红蛋白正常可排除腹腔实质性脏器损伤，结合患者病史、体查和实验室检查，应考虑急性胃十二指肠溃疡穿孔。若腹穿抽出较多液体，提示腹腔内有较多渗出液，腹腔污染严重，因此应尽早进行手术探查（E对），明确损伤部位，彻底解除病因。胃肠减压，输液（A错）、镇痛镇静治疗（B错）、应用抗生素（C错）和纠正水、电解质及酸碱平衡紊乱（D错）均为一般治疗措施，不能从根本上解决引起腹腔渗液的原因。